关于统计表的列表原则，下列哪项叙述是错误的
A. 备注可在表内用“*”标出，写在表的底线下
B. 横标目是研究对象，列在表的上行
C. 表内的数据一律用阿拉伯数字表示
D. 统计表中线条不宜过多
E. 标题在表的上方中央，简要说明表的内容

正确答案：B。横标目是研究对象，列在表的上行